男性，30岁。头痛，时有呕吐，逐渐加重1个月，近期嗜睡，反应迟钝，时有头晕猝倒，无头部外伤及急性炎症病史，血压正常。检查见视神经乳头水肿，血常规血沉正常。根据以上的检查结果，最重要的治疗是
A. 降低颅内压
B. 药物镇静治疗
C. 手术治疗
D. 抗炎治疗
E. 吸氧治疗

正确答案：C。手术治疗

解析：颅内肿瘤不论良性还是恶性，均应首选手术切除（C对）（七版黄家驷外科学P874）。良性肿瘤完全切除大多可以根治；非良性即使部分切除，也可明确肿瘤的性质和级别，有利于选择合适的治疗方案、估计预后。降低颅内压（A错）、药物镇静治疗（B错）、抗炎治疗（D错）、吸氧治疗（E错）均为一般性辅助治疗措施，不能从根本上去除病因。